下列对WHO提出的健康社会决定因素论表述正确的是
A. 不需要依赖医学手段
B. 单纯依赖医学手段解决健康问题的深层根源
C. 依赖卫生系统内外部门解决健康问题的深层根源
D. 依赖政府部门解决健康问题的深层根源
E. 医学手段结合卫生系统、政府部门推动健康管理与治理政策研究和时间的全面开展

正确答案：E。医学手段结合卫生系统、政府部门推动健康管理与治理政策研究和时间的全面开展

解析：本题考查健康社会决定因素论。WHO提出的健康社会决定因素论说明需要卫生系统内外、政府内外多部门的协调行动，共同推动健康管理与治理政策研究和实践的全面开展（E对ABCD错）。